完成一位患者的治疗后，只要丢弃这些屏障，被覆盖的部分不需要进行清洁消毒（除非有破损），既保持了物体表面的清洁又节省了时间，是以下哪种技术的优点
A. 地面消毒
B. 屏障防护技术
C. 器械消毒
D. 空气消毒
E. 敷料消毒

正确答案：B。屏障防护技术

解析：采用屏障保护技术的优点在于完成一位患者的治疗后，只要丢弃这些屏障，被覆盖的部分不需要进行清洁消毒（除非有破损），治疗区域其他暴露部分及缺损部位在治疗两位患者之间必须清洁。这样既保持了物体表面的清洁又节省了时间。掌握“患者、医务人员及环境的防护”知识点。